能促进根尖周组织修复的充填材料是
A. 氢氧化钙
B. 氯仿牙胶
C. 氧化锌丁香油粘固粉
D. 桉油牙胶
E. 碘仿糊剂

正确答案：A。氢氧化钙

解析：本题考查能促进根尖周组织修复的充填材料。氢氧化钙（A对）作为充填材料主要优点是具有较好的抗菌效果，诱导硬组织形成，促进根尖周组织愈合。氯仿牙胶（B错）和桉油牙胶（D错）是分别利用氯仿和桉油软化牙胶尖，以适应不同根管形态的要求，不具有促进根尖周组织修复的作用。氧化锌丁香油粘固粉（C错）有收敛和抗菌作用，但是对根尖周组织有轻度的致炎性，可产生轻微炎症，导致疼痛、愈合迟缓等。碘仿糊剂（E错）具有吸收渗出的作用，并不能促进根尖周组织修复。